男，40岁。发现血尿、蛋白尿5年。查体：BP150/90mmHg，24小时尿蛋白定量1.0～1.7g，血肌酐100μmol/L。治疗的主要目标是：
A. 防止或延缓肾脏病进展
B. 降血压
C. 消除尿蛋白
D. 消除血尿
E. 消除水肿

正确答案：A。防止或延缓肾脏病进展

解析：患者初步诊断为慢性肾炎，慢性肾炎治疗的主要目标是防止或延缓肾脏病（A对）及改善或缓解临床症状及防治心脑血管并发症，而不是以消除血尿（D错）或轻度蛋白尿（C错）为目标。高血压和尿蛋白是加速肾小球硬化、促进肾功能恶化的重压因素，积极降血压（B错）和减少尿蛋白是治疗的重要环节，但并不是治疗目的。消除水肿（E错）在慢性肾炎的利尿降血压和减少尿蛋白的治疗过程中可兼顾，但不是主要目标。